属于天台乌药散组成药物的是
A. 川楝子
B. 陈皮
C. 草豆蔻
D. 肉桂
E. 厚朴

正确答案：A。川楝子

解析：本题考查天台乌药散的组成，属于记忆内容。天台乌药散由天台乌药、木香、小茴香、青皮、高良姜、槟榔、川楝子、巴豆组成。川楝子属于天台乌药散组成药物（A对）。趣记：天台五妖想练兵，回想把良将请。―天台乌药香楝槟，茴香巴姜青。